以下眼疾，与晶状体病变关系最为密切的是
A. 白内障
B. 青光眼
C. 斜视
D. 色盲
E. 视网膜剥离

正确答案：A。白内障

解析：白内障（A对）是指晶状体若因疾病或创伤而变混浊，即与晶状体病变关系最为密切。青光眼（B错）是指房水代谢紊乱或循环不畅而造成的眼内压增高。视网膜剥离（E错）由于玻璃体的支撑作用减弱而导致。